COPD患者长期家庭氧疗的氧流量是
A. 2～3L／min
B. 3.5～4.5L／min
C. 0.5～1L／min
D. 1～2L／min
E. 1.5～2.5L／min

正确答案：D。1～2L／min

解析：COPD患者长期家庭氧疗，一般用鼻导管吸氧，氧流量为1～2L／min（D对），吸氧时间为10-15h/d目的是使患者在静息的状态下，达到Pa02≥60mmHg和（或）SaO2＞90％。